患者多食，大便每日2～3次查体，血压140/60mmHg，双眼突出，心律不齐，脉搏短绌。应首先考虑的是
A. 糖尿病合并缺血性心脏病
B. 风心病伴心房纤颤
C. 高血压性心脏病伴心房纤颤
D. 肺心病伴心房纤颤
E. 甲状腺功能亢进症伴心房纤颤

正确答案：E。甲状腺功能亢进症伴心房纤颤

解析：患者血压血压140/60mmHg，心律不齐，脉搏短绌，考虑心房纤颤，双眼突出，多食，大便次数多，说明代谢旺盛，考虑甲状腺功能亢进症（E对）。糖尿病患者诊断应检测血糖，是否有异常，缺血性心脏病包括粥样硬化病变引致的冠状动脉梗阻或狭窄（A错）。风心病是由于风湿热活动，累及心脏瓣膜而造成的心脏瓣膜病变。表现为二尖瓣、三尖瓣、主动脉瓣中有一个或几个瓣膜狭窄和（或）关闭不全（B错）。高血压性心脏病是高血压长期控制不佳可引起心脏结构和功能的改变称为高血压性心脏病，包括：早期左室舒张功能减退、左室肥厚（LVH），逐步发展出现心肌收缩功能减退最终发生心力衰竭（C错）。肺心病表现为慢性咳嗽、咳痰、气急，活动后心悸、呼吸困难、乏力和劳动耐力下降（D错）。